制备注射用水的水源可选用
A. 去离子水
B. 蒸馏水
C. 两者都可
D. 两者都不可

正确答案：C。两者都可

解析：本题考查注射用水。注射用水为纯化水经蒸熘所得的水。纯化水为饮用水经蒸熘法、离子交换法、反渗透法或其他适宜方法制得的制药用水，不含任何附加剂。因此，制备注射用水的水源为去离子水或蒸馏水（C对）。